临产开始的标志是
A. 有宫缩
B. 见红
C. 胎儿下降感
D. 破膜
E. 有规律且逐渐增强的子宫收缩

正确答案：E。有规律且逐渐增强的子宫收缩